以下属于功能最强的APC的是
A. 树突细胞
B. 黑色素细胞
C. T细胞
D. B细胞
E. NK细胞

正确答案：A。树突细胞

解析：树突细胞是功能最强的APC，能够刺激初始T细胞增殖，是适应性T细胞免疫应答的始动细胞。掌握“NK细胞、抗原提呈及其他免疫细胞”知识点。